急性浆液性根尖周炎与急性浆液性牙髓炎主要区别点包括
A. 患牙咬合痛
B. 自发性、持续性钝痛
C. 疼痛范围局限，能指明患牙
D. 牙髓活力电测验多无反应
E. 以上均是

正确答案：E。以上均是

解析：本题考查急性浆液性根尖周炎与急性浆液性牙髓炎的区别。急性浆液性根尖周炎的病变主要集中在根尖周组织，患者主诉咬合痛（A对）、自发性、持续性钝痛（B对）且疼痛范围局限，能指明患牙（C对），牙髓活力电测验多无反应（D对）。（ABCD均对，故E为本题的正确答案）。而急性浆液性牙髓炎主要为牙髓的急性炎症，患者无咬合痛，疼痛的特点为：自发性阵发性痛、夜间痛、温度刺激加剧疼痛、疼痛不能自行定位，而且急性牙髓炎牙髓电活力测验可有反应。